引起严重急性呼吸道综合征（SARS）的病原体是
A. 肺炎衣原体
B. 军团菌
C. 肺炎支原体
D. 副黏病毒
E. 新型冠状病毒

正确答案：E。新型冠状病毒

解析：本题考查引起严重急性呼吸道综合征（SARS）的病原体。引起严重急性呼吸道综合征（SARS）的病原体是新型冠状病毒（E对）。肺炎衣原体（A错）引起咽炎、肺炎等呼吸道感染。军团菌（B错）可引起军团菌肺炎等。肺炎支原体（C错）可引起上呼吸道感染、非典型肺炎、支气管炎、肺外症状（皮疹、心血管和神经系统症状）。副黏病毒（D错）可引起普通感冒、支气管炎、肺炎、麻疹、脑炎、流行性腮腺炎等感染性疾病。